抗体形成细胞实验可检测
A. 细胞免疫功能
B. 体液免疫功能
C. 巨噬细胞功能
D. 宿主抵抗力
E. 以上都不是

正确答案：B。体液免疫功能